“没有疾病和症状就是健康”的观点属于
A. 神灵主义的健康观
B. 自然哲学的健康观
C. 恩格尔医学模式的健康观
D. 生物医学模式的健康观
E. 整体医学模式的健康观

正确答案：D。生物医学模式的健康观